雄黄的条痕色是
A. 红棕色
B. 白色
C. 樱红色
D. 橘红色
E. 绿黑色

正确答案：D。橘红色